为确定肝脓肿穿刺点或手术引流进路，首选的辅助检查方法是
A. 腹部X线平片
B. B超
C. CT
D. MRI
E. 肝动脉造影

正确答案：B。B超

解析：B超对液体成像较佳，且肝脏贴近胸壁，其它器官对肝脏成像影响较小。B超（B对）检查可以准确测定脓肿部位、大小及距体表深度，是确定脓肿穿刺点或手术引流进路的首选检查。通过观察膈肌、胃、胸腔积液等肝脏周边器官组织在腹部x线平片（A错）上显像的变化，只能推断脓肿的大体方位，但其成像尚不足为确定肝脓肿穿刺点或手术引流进路提供方案。CT（C错）、MRI（D错）、肝动脉造影（E错）操作繁琐、价格昂贵，不作为首选检查。